素质发育特点中，以下哪一项表述是错误的
A. 速度发育较早
B. 耐力发育最晚
C. 腰腹肌力发育较早
D. 下肢爆发力居中
E. 臂肌静止耐力发育比较晚

正确答案：B。耐力发育最晚

解析：本题考查素质发育的特点。各项素质发育的顺序大致为：速度（A对）、耐力（B错，为本题正确答案）、腰腹肌力量发育较早（C对），其后为下肢爆发力（D对），而臂肌静止耐力发育比较晚（E对）。